消毒牛奶的脂肪含量应不低于
A. 3%
B. 2%
C. 1.5%
D. 1%
E. 0.5%

正确答案：A。3%